对于存在明显肝首过效应的药物，宜采用的剂型有
A. 舌下片
B. 肠溶片
C. 控释片
D. 口服乳剂
E. 气雾剂

正确答案：A、E。舌下片；气雾剂

解析：本题考查药物剂型与制剂。对于存在明显肝首过效应的药物，宜采用的剂型有舌下片（A对）、气雾剂（E对）。首关效应是指口服药物在胃肠道吸收后，部分可被代谢灭活而使进入人体循环的药量减少的现象；为避免首过效应，常采用注射剂、舌下片、鼻腔、肺部、直肠下部给药或经皮方式给药；肠溶片（B错）、控释片（C错）、口服乳剂（D错）都需经过胃肠道吸收，首关效应不可避免。